某医师治疗热入心包、热盛动风所致的高热烦躁，神昏谵语，常用万氏牛黄清心丸。此因该成药除清热解毒外，又能
A. 解郁安神
B. 镇惊安神
C. 开窍安神
D. 养心安神
E. 止痉安神

正确答案：B。镇惊安神

解析：本题考查的是万氏牛黄清心丸的功能。万氏牛黄清心丸除清热解毒外，又能镇惊安神（B对）。万氏牛黄清心丸：【功能】清热解毒，镇惊安神。解郁安神颗粒：【功能】疏肝解郁，安神（A错）定志。紫雪散：【功能】清热开窍，止痉安神（CE错）。酸枣仁：【功效】养心安神（D错），敛汗。